某女，26岁。妊娠期间发现血糖升高，多食，口渴，小便频数量多；舌红苔薄黄，脉滑数。临床处方含有石膏、熟地黄、麦冬、知母、牛膝等，方中属于妊娠慎用的中药是
A. 石膏
B. 熟地黄
C. 牛膝
D. 麦冬
E. 知母

正确答案：C。牛膝

解析：本题考查妊娠慎用中药。临床处方含有石膏、熟地黄、麦冬、知母、牛膝等，方中属于妊娠慎用的中药是牛膝（C对）。妊娠慎用中药：人工牛黄、三七、大黄、川牛膝、制川乌等。妊娠禁用中药：丁公藤、三棱、干漆、土鳖虫、千金子、千金子霜、川乌、马钱子等。脾胃虚弱者慎用石膏（A错）。脾虚痰多气郁者慎用熟地黄（B错）。脾胃虚寒作泄、痘疮虚寒泄泻及产后虚寒便溏腹泻诸症不宜使用麦冬（D错）。脾胃虚弱，泄泻，大便稀溏，食纳不化，或胃虚不思饮食等症者，禁用知母（E错）。